生态系统健康是指
A. 具有活力和自调节能力、结构稳定的生态系统，是生态系统的综合特征
B. 活力包括维持系统本身复杂特性的功能和为人类的服务功能
C. 自调节能力主要靠其反馈作用，通过正、负反馈的相互作用和转化，在受到威胁时维持系统的正常结构和功能，保证系统达到一定的稳态
D. 结构稳定指具有平衡、完整的生物群落，多样的生物种群
E. 以上均是

正确答案：E。以上均是

解析：本题考查生态系统健康。生态系统健康是指具有活力和自调节能力、结构稳定的生态系统，是生态系统的综合特性。活力指生态系统的功能性，包括维持系统本身复杂特性的功能和为人类的服务功能；结构稳定指具有平衡、完整的生物群落，多样的生物种群；生态系统自调节功能主要靠其反馈作用，通过正、负反馈相互作用和转化，在受胁迫时能维护系统正常结构和功能，有抵御“疾病”的能力，维持系统稳态（E对ABCD错）。